选择性抑制环氧酶-2（COX-2）的药物是
A. 对乙酰氨基酚
B. 吡罗昔康
C. 塞来昔布
D. 双氯芬酸
E. 阿司匹林

正确答案：C。塞来昔布

解析：本题考查选择性抑制COX-2的药物。塞来昔布（C对）属于选择性COX-2抑制剂代表药；对乙酰氨基酚（A错）通过抑制下丘脑调节中枢前列腺素合成酶发挥作用；吡罗昔康（B错）对COX-2的抑制作用比COX-1强，有一定的选择性；双氯芬酸（D错）抑制前列腺素合成酶,使前列腺素生物合成受阻；阿司匹林（E错）为非选择性环氧酶抑制剂。